有“精血同源”关系的是
A. 脾胃关系
B. 肝胆关系
C. 心肾关系
D. 肝肾关系
E. 肝肺关系

正确答案：D。肝肾关系

解析：精血同源：肝藏血，肾藏精，精血同源于水谷精微，且能相互转化资生，故称“精血同源”（D对）。肾精肝血，荣则俱荣，损则俱损，肝血不足与肾精亏虚多相互影响，以致出现头昏目眩、耳聋耳鸣、腰膝酸软等肝肾精血两亏之证；脾与胃的关系，主要包括水谷纳运协调、气机升降相因、阴阳燥湿相济等（A错）；肝与胆的关系，主要表现在同司疏泄、共主勇怯等方面（B错）；心与肾的关系，主要表现为水火既济、精神互用、君相安位等方面（C错）；肺与肝的关系，主要体现在调节人体气机升降方面（E错）。